前瞻性调查是指
A. 现况调查
B. 队列研究
C. 病例对照调查
D. 临床实验
E. 社区实验

正确答案：B。队列研究

解析：本题考查前瞻性队列研究的概念。前瞻性队列研究是队列研究（B对ACDE错）的基本形式。研究对象的分组是根据研究对象现时的暴露状况而定的，此时研究的结局还没有出现，需要前瞻观察一段时间才能得到。